下列对心房颤动无治疗作用的药物是
A. 强心苷（甙）
B. 奎尼丁
C. 利多卡因
D. 维拉帕米
E. 普萘洛尔

正确答案：C。利多卡因

解析：利多卡因（C错，为本题正确答案）为Ⅰb类，主要治疗室性心律失常，对房性心律失常疗效差。强心苷（A对）（P237）特别适用于心室率快的房颤。奎尼丁（B对）（P195）为广谱抗心律失常药，适用于房颤、房扑、室上性和室性心动过速的转复和预防，房颤和房扑目前虽多采用电转律法，但奎尼丁仍可用于转复后防止复发。维拉帕米（D对）（P198）用于治疗室上性和房室结折返性心律失常，是阵发性室上性心动过速的首选药，房颤也是其中的适应症。普萘洛尔（E对）（P197）主要治疗室上性心律失常，尤其治疗交感神经兴奋性过高、甲状腺功能亢进及嗜络细胞瘤等引起地窦性行动过速效果良好，合用强心苷或地尔硫䓬、控制房扑、房颤及阵发性室上心动过速时的心室率过快效果较好。